对于Ⅲ度和Ⅳ度根分叉病变的治疗目的是
A. 争取有一定程度的牙周组织再生
B. 在基础治疗后，行翻瓣手术消除牙周袋，以利于菌斑控制
C. 使根分叉区充分暴露，以利菌斑控制
D. 骨质破坏较多可行根向复位瓣手术和骨成形术
E. 骨质破坏较轻可行引导性组织再生术

正确答案：C。使根分叉区充分暴露，以利菌斑控制

解析：Ⅲ度和Ⅳ度根分叉病变治疗目的是使根分叉区充分暴露，以利菌斑控制。掌握“根分叉病变”知识点。